男，45岁。发现颈部肿物3个月，无不适，无结核病史。查体：左颈部外侧中部有肿块，25mm大小，活动，无压痛，甲状腺未触及结节。若以上的检查方法未能明确诊断，而肿块仍在增大，其进一步的检查是
A. 用抗生素治疗、观察
B. 肿瘤标记物检查
C. 肿块切除活检
D. 复查MRI
E. 同位素扫描

正确答案：C。肿块切除活检

解析：若细针穿刺细胞学检查未能明确诊断，则进一步的检查是肿块切除活检（C对），该法取得的样本量大，且保留了原本的组织结构，可同时进行细胞学诊断及组织病理学诊断。该患者肿块进行性增大，炎性肿块的可能性较小，用抗生素治疗观察（A错）会贻误治疗时机。肿瘤标记物检查（B错）可用于肿瘤的早期发现、诊断、分期、预后及治疗监测等，但并不能用于确诊。复查MRI（D错）可进一步了解肿块结构及毗邻，但不能明确肿块性质。同位素扫描（E错）为影像学检查，不能确诊颈部肿块性质。